不接触患者口腔参与口腔诊疗服务的口腔器械为
A. 高危器械
B. 中危器械
C. 低危器械
D. 超高危器械
E. 超低危器械

正确答案：C。低危器械

解析：低危器械指不接触患者口腔或间接接触患者口腔，参与口腔诊疗服务，虽有微生物污染，但在一般情况下无害，只有受到一定量的病原微生物污染时才造成危害的口腔器械。掌握“口腔器械的消毒与灭菌及医疗废物处理”知识点。